知母的性能特点有
A. 苦寒清泄
B. 甘寒滋润
C. 上能清肺润燥
D. 中能清胃生津
E. 下能滋肾降火

正确答案：A、B、C、D、E。苦寒清泄；甘寒滋润；上能清肺润燥；中能清胃生津；下能滋肾降火

解析：本题考查知母的性能特点。知母的性能特点有苦寒清泄（A对）、甘寒滋润（B对）、上能清肺润燥（C对）、中能清胃生津（D对）、下能滋肾降火（E对）。知母【性能特点】本品苦泄寒清，甘润滋滑，既入肺、胃经，又入肾与大肠经。但清降，不透散，并滋阴。上清肺热而泻火，中清胃热而除烦渴，下滋肾阴而润燥滑肠、退虚热。清热泻火虽不及石膏，但长于滋阴润燥，祛邪扶正两相兼。实火、虚热皆宜，高热或燥热津伤及阴虚发热者用之尤佳。